关于有机磷农药在体内的分布，表述不正确的是
A. 迅速分布全身
B. 以肝含量最高
C. 可透过血脑屏障
D. 部分可透过胎盘屏障
E. 以中枢神经系统内含量最高

正确答案：E。以中枢神经系统内含量最高